具有协同增效作用的中西药联合用药组是
A. 山楂与磺胺嘧啶
B. 金银花与青霉素
C. 山茱萸与林可霉素
D. 五倍子与多酶片
E. 石麦汤与氯氮平

正确答案：B。金银花与青霉素

解析：本题考查的是中西药联用的特点。具有协同增效作用的中西药联合用药组是金银花与青霉素（B对）。许多中西药联用后，常能使疗效提高，呈现药物之间的协同作用，如金银花能加强青霉素对耐药性金黄色葡萄球菌的杀菌作用。山楂与磺胺嘧啶（A错）联用会影响排泄。含有机酸成分的中药，如乌梅、山茱萸、陈皮、木瓜、川芎、青皮、山楂、女贞子等与磺胺类药物、利福平、阿司匹林等酸性药物合用时，因尿液酸化，可使磺胺类药物的溶解性降低，导致尿中析出结晶，引起结晶尿或血尿，增加磺胺类药物的肾毒性。山茱萸与林可霉素（C错）联用会影响吸收。含有果胶类药物，如六味地黄丸、人参归脾丸、山茱萸等不宜与林可霉素（洁霉素）同服，同服后可使林可霉素的透膜吸收减少90%。五倍子与多酶片（D错）联用会影响吸收。含鞣质较多的中药及其中成药，如五倍子、地榆、诃子、石榴皮、大黄等，不可与胃蛋白酶合剂、淀粉酶、多酶片等消化酶类药物联用。因这些酶类药物的化学成分主要为蛋白质，含有肽键或酰胺键，极易与鞣质结合发生化学反应，形成氢键络合物而改变其性质，不易被胃肠道吸收，从而引起消化不良、纳呆等症状。石麦汤与氯氨平（E错）联用能降低副作用。某些化学药品虽治疗作用明显但毒副反应却较大，若与某些适当的中药配伍，既可以提高疗效，又能减轻毒副反应。氯氮平治疗精神分裂症有明显疗效，但最常见的不良反应之一是流涎。应用石麦汤（生石膏、炒麦芽）30～60剂为1疗程，流涎消失率为82.7%，总有效率达93.6%。